肋
A. 呈长条形，属长骨
B. 上6对肋直接与胸骨相连故称真肋
C. 第2肋平对胸骨角
D. 肋结节与椎体肋凹相关节
E. 第8-12肋组成肋弓

正确答案：C。第2肋平对胸骨角

解析：肋骨属扁骨（A错），第 1 -7 对肋前端直接与胸骨连结，称真肋（B错），肋颈外侧的粗糙突起，称肋结节, 与相应的胸椎横突肋凹相关节（D错）。第 8 -10 对肋肋前端借肋软骨与上位肋软骨连结，形成肋弓（E错）。胸骨角, 可在体表扪及，两侧平对第 2 肋，是计数肋的重要标志（C对）。